影响核酸代谢的药物是
A. 间羟胺
B. 维拉帕米
C. 氟尿嘧啶
D. 奥美拉唑
E. 异丙肾上腺素

正确答案：C。氟尿嘧啶

解析：本题考查影响核酸代谢的药物。氟尿嘧啶（C对）能够抑制胸腺嘧啶核苷酸合成酶，干扰DNA的合成，影响核酸代谢。间羟胺（A错）和异丙肾上腺素（E错）为肾上腺素受体激动剂，维拉帕米（B错）为钙离子通道拮抗剂，奥美拉唑（D错）为质子泵抑制剂，以上四种均与核苷代谢无关。